牙周组织的主要防御机制有
A. 上皮屏障
B. 吞噬细胞
C. 龈沟液
D. 唾液
E. 以上都是

正确答案：E。以上都是

解析：本题考查牙周疾病促进因素。牙周组织的防御机制包括：①上皮屏障（A对）；②吞噬细胞（B对）；③龈沟液（C对）；④唾液（D对）。因此选E。